氟康唑抗真菌的作用机制是
A. 阻止核酸合成
B. 抑制细胞膜类固醇合成，使其通透性增加
C. 抑制二氢叶酸合成酶
D. 抑制二氢叶酸还原酶
E. 抑制蛋白质合成

正确答案：B。抑制细胞膜类固醇合成，使其通透性增加

解析：本题考查氟康唑的作用机制。氟康唑抗真菌的作用机制是抑制细胞膜类固醇合成，使其通透性增加（B对）。氟康唑是吡咯类药物，吡咯类药物作用机制是通过抑制真菌中由细胞色素P450介导的14α-甾醇去甲基化，从而抑制真菌细胞膜类固醇类合成，损伤真菌细胞膜并改变其通透性，以致真菌死亡。